女，20岁，低热干咳1个月，胸痛1周，查体37.8℃，诊断
A. 肺癌左胸腔转移
B. 支气管扩张
C. 气胸
D. 结核性胸膜炎
E. 慢阻肺

正确答案：D。结核性胸膜炎

解析：该患者女，20岁(青年人)，出现低热干咳，胸痛(结核性胸膜炎的表现)，查体37.8℃，结合患者年龄和表现，诊断为结核性胸膜炎（D对）。肺癌转移累及胸膜或肺淋巴回流受阻，可引起胸腔积液（A错）。支气管扩张主要症状为持续或反复的咳嗽、咳痰或咳脓痰。痰液为黏液性、黏液脓性或脓性，可呈黄绿色，收集后分层：上层为泡沫，中间为浑浊黏液，下层为脓性成分，最下层为坏死组织。（B错）。气胸大多数起病急骤，病人突感一侧胸痛，针刺样或刀割样，持续时间短暂，继之胸闷和呼吸困难，可伴有刺激性咳嗽，系气体刺激胸膜所致，（C错）。慢阻肺：1.慢性咳嗽常晨间咳嗽明显，夜间阵咳或排痰。一般为白色黏液或浆液泡沫性痰，偶可带血丝，清晨排痰较多。急性发作期痰量增多，可有脓性痰。3.气短或呼吸困难 早期在较剧烈活动时出现，后逐渐加重，以致在日常活动甚至休息时也感到气短，是慢阻肺的标志性症状。4.喘息和胸闷 部分病人特别是重度病人或急性加重时出现喘息。（E错）。